肾上腺皮质功能不全采用
A. 糖皮质激素替代治疗法
B. 早期、大剂量、短期应用糖皮质激素
C. 抗菌药物与糖皮质激素合用
D. 抗结核病药与糖皮质激素合用
E. 糖皮质激素与肾上腺素合用

正确答案：A。糖皮质激素替代治疗法

解析：本题考查肾上腺皮质功能不全的治疗。肾上腺皮质功能不全采用糖皮质激素替代治疗法（A对）。小剂量替代疗法用于急、慢性肾上腺皮质功能减退症（包括肾上腺危象、艾迪生病）、腺垂体功能减退症及肾上腺次全切除术后。早期、大剂量、短期应用糖皮质激素（B错）用于严重中毒性感染及各种休克。抗菌药物与糖皮质激素合用（C错）用于急性细菌感染的治疗。抗结核病药与糖皮质激素合用（D错）一般用于结核病菌感染的患者。糖皮质激素与肾上腺素合用（E错）用于过敏性休克。